以下各项，属于灭菌法是
A. 洗手
B. 碘类消毒
C. 电离辐射
D. 紫外线
E. 超声波

正确答案：C。电离辐射

解析：灭菌法可杀灭一切微生物，如热力灭菌、电离辐射（C对）、微波等物理消毒法，化学消毒剂，如醛类、环氧乙烷、过氧化氢、过氧乙酸等。洗手属于低效消毒法（A错）。超声波、碘类消毒法属于中效消毒法（BE错）。紫外线属于高效消毒法（D错）。